使用过量最易引起心律失常的拟肾上腺素能药物是
A. 去甲肾上腺素
B. 间羟胺
C. 麻黄碱
D. 多巴胺
E. 肾上腺素

正确答案：E。肾上腺素